好发于儿童的癣是
A. 白癣、手癣
B. 黄癣、白癣
C. 体癣、花斑癣
D. 脚癣、花斑癣
E. 黄癣、体癣

正确答案：B。黄癣、白癣

解析：白癣多见于学龄儿童，男性多于女性。黄癣多见于农村，好发于儿童（B对）。手癣多见于成年人，男女老幼均可发病（A错）。体癣多见于青年男性（CE错）。花斑癣多发于多汗体质青年。脚癣多发于成年人，儿童少见（D错）。